卫生毒理学研究的任务是
A. 中毒机制
B. 外来化合物进入机体的途径及生物转运、转化过程
C. 对外来化合物进行安全性评价
D. 制定有关卫生标准和管理方案
E. 以上都是

正确答案：E。以上都是